下列为脂解激素的是
A. 胰岛素
B. 前列腺素
C. 促胰岛素合成激素
D. 促性腺激素
E. 促肾上腺皮质激素

正确答案：E。促肾上腺皮质激素

解析：脂肪细胞中储存的甘油三酯经一系列脂肪酶依次催化，逐步水解释出甘油和游离脂肪酸，运送到全身各组织利用，此过程称为脂肪动员。在脂肪动员过程中，胰高血糖素、肾上腺素、促肾上腺皮质激素及甲状腺素等促进其活性，称为脂解激素。掌握“脂肪的分解代谢”知识点。